一侧颈5平面以下痛觉完全消失，对侧深感觉消失，病变部位在
A. 脊髓横贯
B. 脊髓后根
C. 脊髓半侧
D. 脊髓前联合
E. 脊髓后角

正确答案：C。脊髓半侧

解析：脊髓半切综合征的特点为典型的患侧深感觉障碍、对侧浅感觉障碍，由于后角细胞发出的纤维先在同侧上升2-3个节段后再经白质前连合交叉至对侧组成脊髓丘脑束，故对侧传导束性感觉障碍平面较脊髓损害节段水平低。该患者一侧颈5平面以下痛觉完全消失，对侧深感觉消失，为脊髓半切综合征，病损部位在脊髓对侧（C对）C2-3处。脊髓横贯（A错）表现为受损平面以下各种感觉缺失，上运动神经元瘫痪及括约肌障碍（P22）。脊髓后根（B错）表现为神经根痛，神经根支配的相应区域的麻木等。脊髓前联合（D错）表现为双侧对称的分离性感觉障碍（痛温觉减弱或消失，触觉保留）（P22）。脊髓后角（E错）表现为病灶侧相应皮节出现同侧痛温觉缺失、触觉保留的分离性感觉障碍（P22）。